痛经气血虚弱证的治法是
A. 理气化瘀止痛
B. 温经暖宫止痛
C. 益气养血止痛
D. 清热除湿，化瘀止痛
E. 益肾养肝止痛

正确答案：C。益气养血止痛

解析：气血不足，冲任益虚，胞宫失养，不荣则痛，治当益气养血止痛（C对）。肝失调达，冲任气血郁滞，经血不利，不通则痛，治疗当理气化瘀止痛（A错）。肾阳亏虚，冲任失煦，不荣则痛，治当温经暖宫止痛（B错）。脾气亏虚，运化失司，内生湿邪，郁而化热，湿热蕴结，瘀阻胞宫，不通则痛，治当清热除湿，化瘀止痛（D错）。肝肾阴虚，阴血不足，冲任失养，不荣则痛，治当益肾养肝止痛（E错）。